发生室颤时，进行电除颤时单向首选能量是
A. 200J
B. 200～300J
C. 300～360J
D. 360J
E. 400J

正确答案：D。360J

解析：根据第九版外科学教材的说明，心室颤动时首次电除颤，AHA复苏指南推荐直接使用最大能量除颤，双相波200J（或制造商建议的能量，120~200J），单相波360J”。依据九版内科学教材，如采用双相波电除颤，首次能量选择可根据除颤仪的品牌或型号推荐，一般为120J或150J，如使用单相波电除颤，首次能量应选择360J，第二次及后续的除颤能量应相当，而且可考虑提高能量。根据最新教材考虑最佳答案为360J（D对）。现在最新指南是首选双向200J，因为对机体伤害小，次选单相波360J